关于哌替啶药理作用叙述中正确的是
A. 镇痛镇静作用较吗啡弱
B. 可引起便秘，并有止泻作用
C. 对妊娠末期子宫，有抗催产素作用
D. 不扩张血管，不引起体位性低血压
E. 提高胆道压力作用较吗啡强

正确答案：A。镇痛镇静作用较吗啡弱